成人最低生理需碘量约为
A. 75μg/d
B. 100μg/d
C. 150μg/d
D. 200μg/d
E. 250μg/d

正确答案：A。75μg/d

解析：本题考查成人最低生理需碘量。碘是人体必需微量元素，主要来源于食物，其余来源于水和空气。碘的最低生理需要量为每人75μg/d（A对BCDE错），供给量为生理需要量的2倍，即每人150μg/d。